在一项随机对照临床试验中，给100例患者用A药，另50例患者用安慰剂治疗，发现A药组40%好转，安慰剂组32%好转，P>0.05，因此
A. 本试验证实A药有效
B. 本试验证实A药无效
C. 差异可能由机会引起
D. 因为样本大小不同，两组比较没有意义
E. 差异可能在1%水平有显著性

正确答案：C。差异可能由机会引起